口腔健康促进的核心组成部分是
A. 口腔健康教育
B. 口腔健康保护
C. 口腔疾病预防
D. 口腔疾病一级预防
E. 社区口腔卫生保健

正确答案：A。口腔健康教育

解析：本题考查口腔健康促进的组成。口腔健康促进的核心组成部分是口腔健康教育（A对）。口腔健康促进是由口腔健康教育、口腔健康保护和口腔疾病预防三部分组成。每个组成部分在个体、群体和社区口腔健康促进中都具有重要作用，三者相互联系和相互促进。1.口腔健康教育：是口腔健康促进的核心组成部分，是一个过程而不是一个结果，与一级、二级、三级预防均有关。2.口腔健康保护（B错）：包括司法和财政控制、其他法规和政策，目的在于促进健康和预防疾病。它的使命是减少人们受到环境危害、不安全或不健康行为危害的可能性。口腔健康保护为人们的口腔健康选择提供了保证。3.口腔疾病预防（C错）：口腔疾病预防在口腔健康促进中起着重要作用。口腔健康促进应以口腔疾病的一级预防为基础。一级预防是在疾病发生前所进行的预防工作，以便阻止疾病的发生，也是口腔健康促进的主要任务。